不支持重症肌无力诊断的临床依据是
A. 运动后四肢易疲劳
B. 波动性眼睑下垂和复视
C. 四肢肌无力晨轻暮重
D. 低频电刺激电位衰减＞10%
E. 疲劳试验休息后症状无改善

正确答案：E。疲劳试验休息后症状无改善

解析：重症肌无力（MG）是一种神经-肌肉接头传递功能障碍的获得性自身免疫性疾病。临床主要表现有运动后四肢易疲劳（A对）、四肢肌无力晨轻暮重（C对）、波动性眼睑下垂和复视（B对），疲劳试验经休息或胆碱酯酶抑制剂治疗后可以缓解（E错，为本题正确答案）。重复神经电刺激检查：低频电刺激电位衰减＞10%（D错）。